凉膈散的君药是
A. 大黄
B. 芒硝
C. 连翘
D. 梔子
E. 黄芩

正确答案：C。连翘

解析：凉膈散主治上中二焦邪郁生热证，连翘轻清透散，长于清热解毒，透散上焦之热，故为君药（C对）。大黄、芒硝泻火通便，以荡涤中焦燥热内结，共为臣药（AB错）。栀子通泄三焦，引火下行为臣药（D错）。黄芩清胸膈郁热（E错）。